男，30岁。粘液脓血便伴里急后重2年。近1周腹痛加重，高热。体检：体温39.2℃，心率110次/分，贫血貌，腹部膨隆，全腹有压痛，肠鸣音消失。该患者不宜选做的检查是
A. 血常规
B. 血沉
C. 免疫指标测定
D. 钡剂灌肠
E. 腹部B超

正确答案：D。钡剂灌肠

解析：患者诊断为溃疡性结肠炎并发中毒性巨结肠。钡剂灌肠（D对）可使结肠内压增大、结肠扩张，诱发或加重中毒性巨结肠，引起急性肠穿孔，故此时该患者禁止行钡剂灌肠。血常规（A错）、血沉（B错）、免疫指标测定（C错）、腹部B超（E错）均为常规检查，且有助于溃疡性结肠炎并发中毒性巨结肠的诊断，患者可以选用。